我国法定职业性肿瘤中不包括
A. 联苯胺所致膀胱癌
B. 苯所致白血病
C. 紫外线所致皮肤癌
D. 氯甲醚所致肺癌
E. 氯乙烯所致肝血管肉瘤

正确答案：C。紫外线所致皮肤癌